心脏压塞的典型体征是
A. 动脉压下降，颈静脉怒张和心音低钝
B. 动脉压下降，奇脉和心音低钝
C. 动脉压上升，颈静脉怒张和心音低钝
D. 动脉压上升，奇脉和心音低钝
E. 奇脉、颈静脉怒张和双下肢水肿

正确答案：A。动脉压下降，颈静脉怒张和心音低钝

解析：短期内出现大量心包积液可引起急性心脏压塞，表现为窦性心动过速、血压下降（CD错）、脉压变小和静脉压明显升高。如果液体积聚较慢，则出现亚急性或慢性心脏压塞，产生体循环静脉淤血征象，表现为颈静脉怒张，双下肢水肿，还可出现奇脉，表现为桡动脉搏动呈吸气性显著减弱或消失、呼气时恢复，但心脏压塞的典型体征是Beck三联征：低血压、心音低弱、颈静脉怒张（A对BE错）。